关于老年人膳食原则的表述，错误的是
A. 减少能量摄入
B. 控制脂肪摄入
C. 摄入大量的动物性蛋白质
D. 多吃蔬菜和水果
E. 碳水化合物以谷类为主，减少精制糖

正确答案：C。摄入大量的动物性蛋白质